不属于精神分裂症常见症状的是
A. 阳性症状
B. 冲动行为
C. 记忆力减退
D. 阴性症状
E. 情感症状

正确答案：C。记忆力减退

解析：精神分裂症患者对时间、空间和人物一般能进行正确的定向，意识通常是清晰的，一般无记忆力减退（C错，为本题正确答案）。精神分裂症的常见症状：1.阳性症状（A对）；2.激越症状：冲动行为（冲动攻击与暴力行为）（B对）和自杀；3.阴性症状（D对）；4.焦虑、抑郁症状；5.自知力：自知力缺乏。